男，52岁，排尿间断性中断，阴茎头部疼痛，转换体位可缓解排尿困难，最可能的诊断是
A. 膀胱结石
B. 前列腺增生
C. 尿道炎
D. 急性细菌性膀胱炎
E. 肾积水

正确答案：A。膀胱结石

解析：膀胱结石的典型症状为排尿突然中断，转换体位可缓解排尿困难（A对）；尿道炎（C错）、急性细菌性膀胱炎（D错）多有尿频、尿急、尿痛属于膀胱刺激征，无痛性血尿多应考虑泌尿系肿瘤。前列腺增生（B错）有排尿困难，无排尿间断性中断。肾积水可有腰腹疼痛，恶心呕吐等症状，与本病不符（E错）。